男性，50岁。既往史不详，突然发生呼吸困难，满肺哮鸣音，心率120次/分，心脏听诊听不清有无杂音，应首选何药
A. 吗啡
B. 毛花苷丙
C. 维拉帕米
D. 氨茶碱
E. 肾上腺素

正确答案：D。氨茶碱

解析：该患者有明显的哮喘症状，但尚不能辨别是心源性哮喘还是支气管哮喘，这种情况下，可静脉注射氨茶碱缓解症状后，进一步检查。忌用肾上腺素或吗啡，以免造成危险。掌握“心力衰竭”知识点。